胺碘酮的作用是
A. 阻滞Na+通道
B. 促K+外流
C. 阻滞Ca2+通道
D. 延长动作电位时程
E. 阻滞β受体

正确答案：D。延长动作电位时程

解析：胺碘酮可以抑制多种离子通道，降低窦房结、蒲肯野纤维的自律性和传导性，明显延长心肌细胞动作电位时程和有效不应期，延长Q-T期间和QRS波。掌握“抗心律失常药”知识点。